孕35周初孕妇，重度子痫前期，患者突发腹痛，4小时后胎心消失，宫底明显升高，子宫强硬，有压痛，宫缩间歇子宫不完全放松，重度贫血貌，阴道少量流血，宫口开1指，头先露，下列何项处理最佳
A. 人工破膜后药物引产
B. 滴注催产素
C. 注射哌替啶调整宫缩
D. 急诊剖宫产术
E. 宫口开全后行穿颅术

正确答案：D。急诊剖宫产术

解析：本例的诊断是胎盘早剥。应立即剖宫产。故选D。“宫底明显升高，子宫强硬，有压痛，宫缩间歇子宫不完全放松，重度贫血貌，阴道少量流血”这些是胎盘早剥的特点。掌握“娠期高血压疾病”知识点。